藿香与佩兰均有的功效是
A. 化湿，行气
B. 化湿，温中
C. 化湿，安胎
D. 化湿，解暑
E. 化湿，止泻

正确答案：D。化湿，解暑

解析：本题考查藿香与佩兰的功效。藿香与佩兰均有的功效是化湿，解暑（D对）。广藿香【功效】化湿，止呕，发表解暑。佩兰【功效】化湿，解暑。砂仁【功效】化湿行气（A错），温中（B错）止泻（E错），安胎（C错）。